关于乳房的描述，错误的说法是
A. 位于浅筋膜内，由皮肤、纤维组织、脂肪组织及乳腺构成
B. 乳头位于锁骨中线第4肋间(或第5肋)水平
C. 乳腺叶及输乳管均以乳头为中心呈放射状排列
D. 乳腺手术采取放射状切口，完全是为了避免损伤乳腺叶
E. 乳腺癌晚期，可致乳腺皮面呈凹皮和橘皮样改变

正确答案：D。乳腺手术采取放射状切口，完全是为了避免损伤乳腺叶

解析：乳房位于浅筋膜内，由皮肤、纤维组织、脂肪组织及乳腺构成（A对），乳头位于锁骨中线第4肋间(或第5肋)水平（B对），腺叶及输乳管均以乳头为中心呈放射状排列（C对），乳腺手术采取放射状切口，是为了避免损伤输乳管（D错为本题正确答案），乳腺癌晚期，可致乳腺皮面呈凹皮和橘皮样改变（E对）。